下列不是目前我国公布的职业卫生标准的是
A. 粉尘、毒物最高容许浓度
B. 物理性有害因素卫生标准
C. 卫生管理标准
D. 煤矿百万吨工伤死亡人数
E. 测定方法标准

正确答案：D。煤矿百万吨工伤死亡人数